头皮瘙痒，多脂多屑，头发脱落，其临床意义是
A. 肾精亏损
B. 血虚受风
C. 肝经风热
D. 血热化燥
E. 脾胃蕴热

正确答案：D。血热化燥

解析：血热化燥，生风，风胜则痒，故出现头皮发痒、多屑、多脂（D对）。肾精亏损会出现头发稀疏黄软（A错）。血虚受风会出现圆形或椭圆形光亮头皮，即斑秃（B错）。